医疗卫生机构发现不明原因的群体性疾病，应当在2小时内向哪个机构报告
A. 所在地县级人民政府
B. 所在地县级人民政府卫生行政主管部门
C. 所在地县级以上人民政府卫生行政部门
D. 设区的市级人民政府
E. 所在地省级卫生行政主管部门

正确答案：B。所在地县级人民政府卫生行政主管部门

解析：突发事件监测机构、医疗卫生机构和有关单位发现上述需要报告情形之一的，应当在2小时内向所在地县级人民政府卫生行政主管部门报告；接到报告的卫生行政主管部门应当在2小时内向本级人民政府报告，并同时向上级人民政府卫生行政主管部门和国务院卫生行政主管部门报告。掌握“突发公共卫生事件报告与法律责任”知识点。